多巴胺舒张肾血管是由于
A. 激动β受体
B. 阻断α受体
C. 激动M胆碱受体
D. 激动多巴胺能受体
E. 使组胺释放

正确答案：D。激动多巴胺能受体